国务院和有关部委出台了一系列支持药品零售连锁发展的政策性文件。关于相关政策的说法，错误的是
A. 国家鼓励药品零售连锁企业在乡镇、村镇设店，支持其进入农村市场
B. 允许药品零售连锁企业委托符合《药品经营质量管理规范》的企业向本企业所属门店配送药品，药品零售连锁企业可以不再设立仓库
C. 鼓励“互联网+药品流通”模式，允许药品零售连锁企业采取“网订店取”“网订店送”方式销售药品
D. 根据《麻醉药品和精神药品管理条例》，药品零售连锁企业均可以经营第二类精神药品

正确答案：D。根据《麻醉药品和精神药品管理条例》，药品零售连锁企业均可以经营第二类精神药品

解析：本题考查的是鼓励药品零售连锁的措施。国务院和有关部委出台了一系列支持药品零售连锁发展的政策性文件。关于相关政策的说法，错误的是根据《麻醉药品和精神药品管理条例》药品零售连锁企业均可以经营第二类精神药品（D错，为本题正确答案）。《麻醉药品和精神药品管理条例》中规定，只有经过审批的药品零售连锁企业定点门店方可经营第二类精神药品。鼓励药品零售连锁的具体措施有：1.允许药品零售连锁委托符合药品GSP的企业向企业所属门店配送药品，药品零售连锁企业可不再设立仓库（B对）。2.鼓励“互联网+药品流通”模式，允许药品零售连锁企业采取“网订店取”“网订店送”方式销售药品（C对）。3.推进基层医疗机构与连锁药店的合作，鼓励连锁药店在社区健康服务、老年患者康复、慢性病人健康管理等方面做出尝试，发挥其服务专业、管理规范的优势和全方位满足人民群众不同用药与健康需求的社会职能。4.鼓励药品零售连锁企业在乡镇、村镇设店的积极性，支持进入农村市场（A对）。